可致肝细胞损害的药有
A. 草乌
B. 鱼胆
C. 黄药子
D. 益母草
E. 苍耳子

正确答案：B、C、E。鱼胆；黄药子；苍耳子

解析：本题考查的是引起肝损伤的中药及其主要化学物质。可致肝细胞损害的药有鱼胆（B对）、黄药子（C对）与苍耳子（E对）。引起肝损伤的中药及其主要化学物质：1.植物类：文献报道多、有明确肝损伤的中药有柴胡、川楝子、苍术、苍耳子、栀子、吴茱萸、艾叶、山豆根、番泻叶、何首乌、黄药子、雷公藤等。其肝毒性与所含成分有关。（1）生物碱类：包括菊科的千里光属（如千里光、菊三七等）、款冬属、蜂斗菜属、泽兰属，紫草科的紫草属、天芥菜属。（2）苷类：含皂苷的中药有三七、商陆、黄药子等。（3）毒蛋白类：如苍耳子、蓖麻子、望江南子、相思豆等。（4）多肽类：其中毒蕈植物中毒蕈伞对肝脏损害最重。（5）萜与内酯类：包括有川楝子、黄药子、艾叶等。（6）鞣质类：包括五倍子、石榴皮、诃子等。2.动物类：（1）蜈蚣；（2）鱼胆；（3）蟾酥；（4）斑蝥；（5）猪胆。3.矿物类：（1）含汞矿物药：主要有朱砂、银朱、红粉、轻粉、白降丹等，其以HgS、HgO、Hg₂Cl₂、HgCl₂等汞化物形式存在。（2）含砷矿物药：包括砒石、雄黄、代赭石等，其毒性成分主要是三氧化二砷（As₂O₃）。（3）含铅矿物药：包括铅丹、密陀僧等。草乌（A错）、益母草（D错）可导致急性肾功能衰竭。常见对肾功能有影响的中药：1.植物类：（1）含生物碱类：如雷公藤、草乌、益母草、蓖麻子、麻黄、北豆根等及含上述中药的一些制剂。（2）含马兜铃酸类：如马兜铃、天仙藤、寻骨风等。（3）含挥发油类：如土荆芥、藿香、茵陈、艾叶等。（4）含蒽醌类：如大黄蒽醌类成分（大黄、番泻叶、芦荟）。（5）苷类：如苍耳子。2.动物类：（1）斑蝥。（2）鱼胆。（3）海马。（4）其他：蜈蚣、蜂毒等。3.矿物类：（1）含砷类：砒石、砒霜、雄黄、红矾，以及中成药牛黄解毒片、安宫牛黄丸、牛黄清心丸、六神丸、砒枣散等。（2）含汞类：朱砂、升汞、轻粉、红粉，以及中成药安宫牛黄丸、牛黄清心丸、朱砂安神丸、天王补心丸、安神补脑丸、苏合香丸、人参再造丸、大活络丸、七厘散、梅花点舌丸、一捻金（胶囊）等。